目前我国发生肝衰竭的重要的病因是
A. 遗传
B. 酒精
C. 病毒
D. 药物
E. 免疫

正确答案：C。病毒

解析：我国发生肝衰竭的重要的病因是病毒（C对），尤其是乙肝病毒，其他因素还有药物（D错）、免疫（E错）等。酒精（B错）是国外导致肝衰竭的重要原因。